华法林起效缓慢，深静脉栓塞治疗的初期，需同时联合使用的药品是
A. 维生素B₁
B. 维生素B₂
C. 维生素B₁₂
D. 依诺肝素
E. 酚磺乙胺

正确答案：D。依诺肝素

解析：本题考查依诺肝素。依诺肝素（D对）用于预防深静脉血栓形成，治疗已经形成的急性深静脉血栓。